对甲类传染病患者实施强制隔离措施时，应当遵循的公共卫生伦理原则不包括的是
A. 社会公正原则
B. 全社会参与原则
C. 互助协同原则
D. 以病人为中心原则
E. 信息公开原则

正确答案：D。以病人为中心原则

解析：公共卫生伦理原则包括社会公正原则（A对）、全社会参与原则（B对）、社会公益原则、互助协同原则（C对）和信息公开原则（E对）等，不包括以病人为中心原则（D错，为本题正确答案）。